极度衰弱时，咳嗽的特征为
A. 咳嗽，声音嘶哑
B. 金属音调咳嗽
C. 犬吠样咳嗽
D. 咳嗽声音低微
E. 阵发性痉挛性咳嗽

正确答案：D。咳嗽声音低微